白介素2可治疗的疾病是
A. 厌食症
B. 心源性水肿
C. 血小板减少性紫癜
D. 肾功能不全
E. 恶性黑色素瘤

正确答案：E。恶性黑色素瘤

解析：本题考查白介素2的药理作用。白介素2可以有效提高抗感染能力，对于调节机体免疫力也有一定的作用。在临床上一般可以用于治疗肿瘤，包括恶性黑色素瘤（E对）。